骨半规管
A. 前骨半规管弓形向上，埋于弓状隆起的深面
B. 外骨半规管弓向外，当头直立平视时与地面平行
C. 后骨半规管是三个骨半规管最长的一个，与颞骨岩部长轴垂直
D. 前骨半规管与外骨半规管合成总骨脚
E. 无

正确答案：A。前骨半规管弓形向上，埋于弓状隆起的深面

解析：前骨半规管弓向上方，埋于颞骨岩部弓状隆起的深面（A对）。外骨半规管弓向外侧，当头前倾30°角时与地面平行（B错）。后骨半规管弓向后外方，是三个半规管中最长的一个，与颞骨岩部的长轴平行 （C错）。前、后半规管的单骨脚合成一个总骨脚（D错）。